无排卵性功能失调性子宫出血的特点是
A. 基础体温双相，月经周期长，经期正常
B. 基础体温双相，月经周期短，经期正常
C. 基础体温双相，月经周期正常，经期延长
D. 基础体温单相，月经周期紊乱，经期长短不一
E. 基础体温双相，月经周期正常，经期长短不一

正确答案：D。基础体温单相，月经周期紊乱，经期长短不一

解析：无排卵性功能失调性子宫出血临床上最常见的症状是子宫不规则出血，表现为月经周期紊乱，经期长度不一，经量不定或增多，甚至大量出血（P346）。基础体温测定（BBT）（P346）不仅有助于判断有无排卵，还可以提示黄体功能不足。基础体温呈单相型，提示无排卵（D对）。基础体温双相，经间期出现不规则出血时，可了解出血在卵泡期、排卵期或黄体期。